强心苷对下列哪种疾病治疗效果较差
A. 收缩功能障碍引起的
B. 对利尿药治疗效欠佳者
C. 对ACE抑制药治疗效欠佳者
D. 对β受体阻断药疗效欠佳者
E. 扩张性心肌病

正确答案：E。扩张性心肌病

解析：治疗心力衰竭：在过去几十年对心力衰竭的治疗中，强心苷加利尿药几乎用于每一位心力衰竭的病人，但随着对心力衰竭病理生理认识的不断加深及对ACE抑制药、β受体阻断药临床疗效的肯定，强心苷现多用于以收缩功能障碍为主，对利尿药、ACE抑制药、β受体阻断药疗效欠佳者。不同原因所致的心力衰竭因病情不同，其疗效有一定的差异：对有心房纤颤伴心室率快的心力衰竭疗效最佳；对瓣膜病、风湿性心脏病（高度二尖瓣狭窄的病例除外）、冠状动脉粥样硬化性心脏病和高血压性心脏病所导致的心功能不全疗效较好；对肺源性心脏病、活动性心肌炎（如风湿活动期）或严重心肌损伤，疗效也较差，且容易发生中毒；对扩张性心肌病，心肌肥厚、舒张性心力衰竭者不应选用强心苷，而应首选β受体阻断药、ACE抑制药。掌握“强心苷、ACE抑制剂”知识点。